盲肠癌患者最少见的合并症是
A. 缺铁性贫血
B. 大肠梗阻
C. 右下腹包块
D. 急性阑尾炎
E. 原因不明的低热和消瘦

正确答案：B。大肠梗阻

解析：盲肠癌以隆起型多见，腹部查体多可触及右下腹包块（C对），但由于右侧结肠内常为从末端回肠排入的稀薄的大便，因此较少合并大肠梗阻（B错，为本题正确答案）。癌肿出血导致慢性失血，患者可出现缺铁性贫血（A对）。盲肠癌肿块较大时，可压迫、堵塞阑尾腔，引起急性阑尾炎，多数患者因急性阑尾炎于术中探查才被确诊为盲肠癌（D对）。盲肠癌晚期可有全身症状，如原因不明的低热、消瘦、乏力等（E对）。